参与B细胞活化的CD分子是
A. CD3
B. CD4
C. CD40
D. CD8
E. CD30

正确答案：C。CD40

解析：B细胞活化需要双信号，第一信号来源于BCR与特异性抗原的结合。结合了抗原的BCR通过系列的信号转导分子将第一激活信号传入细胞核，启动基因的转录。B细胞共受体CD21和CD19的激活可显著提高B细胞对抗原刺激的敏感性。B细胞活化的第二信号来自Th细胞表达的协同刺激分子。活化Th1细胞表达的CD40L与B细胞表面的CD40相互作用，Th细胞表面的ICAM-1和B细胞表面的LFA-1相互作用，Th细胞表面的CD28和B细胞表面的B7相互作用都产生B细胞活化的第二信号。此外，Th2细胞也通过分泌IL-4和IL-5等细胞因子向B细胞传递激活信号。掌握“B细胞、T细胞介导的免疫应答”知识点。